促进微管的装配，抑制其解聚
A. 长春碱
B. 紫杉醇
C. 羟基喜树碱
D. 他莫昔芬
E. 氟他米特

正确答案：B。紫杉醇